麻醉药品和精神药品处方限量的说法正确的是
A. 为住院患开具丁丙诺啡注射剂，每张处方为1日常用量
B. 为门（急）诊一般患者开具吗啡注射剂，每张处方不得超过3日常用量
C. 为门（急）诊一般患者开具氯胺酮注射剂，每张处方不得超过7日常用量
D. 为门（急）诊一般患者开具芬太尼透皮贴剂，每张处方不得超过7日常用量

正确答案：A。为住院患开具丁丙诺啡注射剂，每张处方为1日常用量

解析：本题考查的是处方限量。麻醉药品和精神药品处方限量的说法正确的是为住院患开具丁丙诺啡注射剂，每张处方为1日常用量（A对）。处方限量：处方一般不得超过7日用量；急诊处方一般不得超过3日用量；对于某些慢性病、老年病或特殊情况，处方用量可适当延长，但医师应当注明理由。麻醉药品、精神药品、医疗用毒性药品、放射性药品的处方用量应当严格按照国家有关规定执行。为门（急）诊一般患者开具的麻醉药品注射剂，每张处方为一次常用量（BCD错）；控缓释制剂，每张处方不得超过7日常用量；其他剂型，每张处方不得超过3日常用量。第一类精神药品处方限量同麻醉药品；哌醋甲酯用于治疗儿童多动症时，每张处方不得超过15日常用量。第二类精神药品一般每张处方不得超过7日常用量；对于慢性病或某些特殊情况的患者，处方用量可以适当延长，医师应当注明理由。为门（急）诊癌症疼痛患者和中、重度慢性疼痛患者开具的麻醉药品、第一类精神药品注射剂，每张处方不得超过3日常用量；控缓释制剂，每张处方不得超过15日常用量；其他剂型，每张处方不得超过7日常用量。为住院患者开具的麻醉药品和第一类精神药品处方应当逐日开具，每张处方为1日常用量。对于需要特别加强管制的麻醉药品，盐酸二氢埃托啡处方为一次常用量，仅限于二级以上医院内使用；盐酸哌替啶处方为一次常用量，仅限于医疗机构内使用。